女性，60岁。反复咳嗽、咳痰25年，心悸、气促、下肢间歇水肿3年，病情加重伴畏寒发热1周入院。体检：T38℃，呼吸急促，口唇发绀，双肺叩诊过清音，中下肺有湿啰音，心率110次/分，心律齐，无杂音，双下肢重度水肿。该病例最适当的诊断应为
A. 慢性支气管炎
B. 慢支+肺气肿
C. 慢支+肺气肿+肺心病
D. 慢性阻塞性肺疾病
E. 慢支+肺气肿+心肌病

正确答案：C。慢支+肺气肿+肺心病

解析：患者老年女性，反复咳嗽、咳痰25年（为慢阻肺的标志性症状），查体双肺叩诊过清音，诊断慢支+肺气肿（A错）。患者有下肢间歇水肿病史3年，查体双下肢重度水肿，表明已出现右心衰竭，考虑慢性肺源性心脏病（C对BD错）。患者病情加重伴畏寒发热1周入院，中下肺有湿啰音，说明为急性加重期。心肌病分为原发性和继发性，原发性心肌病主要包括扩张型心肌病、肥厚型心肌病和限制型心肌病；继发性心肌病包括缺血性心肌病、瓣膜性心肌病、高血压性心肌病等，题干所述与心肌病特点不符（E错）。